某男性锅炉操作工，在一个通风不良环境中，连续工作3～4小时后，突感头痛和头晕。查体：患者面色潮红、口唇呈樱桃红色，并伴有呼吸加快等表现。可疑何种毒物中毒
A. 一氧化碳
B. 氰化物
C. 二硫化碳
D. 氮氧化物
E. 硫化氢

正确答案：A。一氧化碳

解析：本题考查急性一氧化碳中毒症状。急性一氧化碳（A对BCDE错）中毒是吸入较高浓度CO后引起的急性脑缺氧性疾病，主要表现为急性脑缺氧引起的中枢神经损害。轻度中毒，以脑缺氧反应为主要表现。病人出现剧烈头痛、头昏等症状，可有意识模糊、嗜睡、短暂昏厥甚至谑妄状态等轻度至中度意识障碍，但无昏迷。中度中毒时除有上述症状外，皮肤、黏膜呈樱桃红色，意识障碍加重，表现为浅至中度昏迷，对疼痛刺激有反应。因HbCO为鲜红色，故病人皮肤黏膜在中毒之初呈樱桃红色，与其他缺氧不同，是其临床特点之一。重度中毒时上述症状进一步加重，因脑水肿而迅速进入深昏迷或去大脑皮层状态。